患儿，男性，3个月。体重6kg。生命体征平稳，心肺未见异常，血尿常规检查未见异常。其左侧上唇连同鼻底裂开，右侧上唇部分裂开，鼻底尚完整。应诊断为
A. 单侧不完全唇裂及Ⅲ度唇裂
B. 左侧Ⅲ度右侧Ⅱ度唇裂
C. 双侧不完全性唇裂
D. 双侧Ⅲ度唇裂
E. 左侧Ⅱ度右侧Ⅲ度唇裂

正确答案：B。左侧Ⅲ度右侧Ⅱ度唇裂

解析：本题考查唇裂的分类。患者左侧上唇连同鼻底裂开，右侧上唇部分裂开，鼻底尚完整。应诊断为左侧Ⅲ度右侧Ⅱ度唇裂（B对）。唇裂国内常用的分类法：1.单侧唇裂：Ⅰ度唇度：仅限于红唇部分的裂开。Ⅱ度唇裂：上唇部分裂开，但鼻底尚完整。Ⅲ度唇裂：整个上唇至鼻底完全裂开。2.双侧唇裂：按单侧唇裂分类的方法对两侧分别进行分类，如双侧Ⅲ度唇裂，双侧Ⅱ度唇裂，左侧Ⅲ度、右侧Ⅱ度混合唇裂等。